房室交点为
A. 前后室间沟的交点
B. 前后室间沟与冠状沟的交点
C. 心大静脉与冠状沟的交叉处
D. 右冠状动脉与冠状沟的交点
E. 后房间沟、后室间沟与冠状沟3者的交点

正确答案：E。后房间沟、后室间沟与冠状沟3者的交点

解析：后房间沟、后室间沟与冠状沟3者的交点（E对）称为房室交点，是心表面的一个重要标志。